慢性肾盂肾炎更为常见的临床表现是
A. 尿白细胞增多或尿菌（+）
B. 腰痛和下腹部疼痛，寒战发热，肾区叩痛（+）
C. 间歇性无症状性细菌尿和间歇性尿频、尿急
D. 水、电解质紊乱及酸碱平衡失调
E. 有多尿期，达3000～5000ml/d

正确答案：C。间歇性无症状性细菌尿和间歇性尿频、尿急

解析：慢性肾盂肾炎更为常见的临床表现程度不同的低热、间歇性尿频、排尿不适、腰部酸痛及肾小管功能受损表现（C对）。尿白细胞增多或尿菌（+）（A错）提示泌尿系感染。腰痛和下腹部疼痛，寒战发热，肾区叩痛（+）（B错），提示急性肾盂肾炎。电解质紊乱及酸碱平衡失调（D错）提示慢性肾衰。有多尿期，达3000～5000ml/d（E错）为急性肾损伤的表现。